管理本行政区域医师工作的机构是
A. 县级以上人民政府劳动人事部门
B. 县级以上人民政府工商行政部门
C. 县级以上人民政府卫生行政部门
D. 各级医师协会
E. 各级政府

正确答案：C。县级以上人民政府卫生行政部门